能使眼球向下外方转的肌是
A. 外直肌
B. 下直肌
C. 上斜肌
D. 下斜肌
E. 无

正确答案：C。上斜肌

解析：外直肌（A错）能使眼球向外方转，下直肌（B错）能使眼球向下内方转，上斜肌（C对）能使眼球向下外方转，下斜肌（D错）能使眼球向上外方转。